肝功能减退者仍可按原剂量给药的抗菌药物为
A. 琥乙红霉素
B. 两性霉素B
C. 利福平
D. 林可霉素
E. 青霉素

正确答案：E。青霉素

解析：本题考查药物代谢。肝功能减退者仍可按原剂量给药的抗菌药物为青霉素（E对），青霉素主要由肾排泄，肝功能减退不需要改变剂量。